髁状突骨折最可能损伤的是
A. 颌外动脉
B. 颌内动脉
C. 颞浅动脉
D. 耳后动脉
E. 面横动脉

正确答案：B。颌内动脉

解析：本题考查髁状突骨折最可能损伤的动脉。颌内动脉位于面侧深区，系颈外动脉的终支之一，于下颌骨髁突颈部的内后方起于颈外动脉，经髁突颈的深面前行至颞下窝，髁状突骨折移位后易伤到颌内动脉（B对）。颌外动脉（A错）起自颈外动脉前臂，行向前内上方，弯曲向下绕过下颌骨向上至面部。颞浅动脉（C错）是颈外动脉的另一终支，在下颌骨髁突颈平面，于腮腺深面，由颈外动脉发出，颞浅动脉走行与髁突上面，不容易损伤。耳后动脉（D错）位置表浅，分布于耳廓后部的皮肤和肌肉，髁突骨折不易伤及。面横动脉（E错）是颞浅动脉穿出腮腺以前发出的分支，越颧弓至邻区，不经过髁突。